某新生儿室发现多名发热、流涕、口唇发绀患儿。患儿体检均发现心动过速，心音低钝。心电图呈心肌炎变现。患儿最可能感染的是
A. 柯萨奇病毒
B. 麻疹病毒
C. 单纯疱疹病毒
D. 腺病毒
E. 乙肝病毒

正确答案：A。柯萨奇病毒

解析：患儿症状、体征及心电图检查结果提示心肌炎，引起儿童心肌炎最常见病毒为柯萨奇病毒（A对）。麻疹病毒（B错）是麻疹的致病病毒。单纯疱疹病毒（C错）可致疱疹性口腔炎。腺病毒（D错）可致腺病毒肺炎。乙肝病毒（E错）可致乙型肝炎。